男，46岁。突发剧烈疼痛，呈撕裂状，累及胸骨后及上腹部，伴大汗，持续1小时不缓解。既往高血压病史5年。查体：BP200/110mmHg，双肺呼吸音清，心率100次/分，心律齐，心脏各瓣膜区听诊未闻及杂音，心电图：左室高电压伴V4～V6导联ST段压低0.1mV。最有助于明确诊断的检查是
A. 超声心动图
B. CT大动脉血管造影
C. 心肌损伤标志物
D. 胸部X线片
E. 动态心电图

正确答案：B。CT大动脉血管造影

解析：46岁中年男性，突发剧烈疼痛（是主动脉夹层最主要和最常见的临床表现），呈撕裂状，累及胸骨后及上腹部，伴大汗，持续1小时不缓解。既往高血压病史（是主动脉夹层最重要的危险因素），查体：BP200/110mmHg（正常值为90～140/60～90mmHg），高血压，心电图：左室高电压伴V4～V6导联ST段压低0.1mV（提示左心室心肌缺血），综合该患者的临床表现、查体、心电图检查，该患者诊断考虑为主动脉夹层。主动脉夹层首选的检查是：血管造影（B对），其敏感性与特异性可达98%左右，主动脉造影可以显示裂口的部位，明确分支和主动脉受累情况，估测主动脉瓣关闭不全的严重程度。超声心动图多用于心脏瓣膜性疾病的诊治，心肌损伤标志物多于心肌梗死的诊断，胸部X线可用于观察心脏大小及外形的改变。